下列这些情况除哪项外均可造成等渗性脱水
A. 大面积烧伤
B. 高热
C. 新生儿消化道先天畸形
D. 抽放大量腹水
E. 小肠梗阻

正确答案：B。高热

解析：等渗性脱水的特点是水钠成比例丢失，血容昼减少，但血清Na＋浓度和血浆渗透压仍在正常范围。大面积烧伤（A对）、抽放大量腹水（D对）时机体丢失大量等渗液，新生儿消化道先天畸形（C对）、小肠梗阻（E对）时机体水分摄入不足，短期内均导致等渗性脱水。高热（B错，为本题正确答案）时机体大量出汗，汗液为低渗液，故可导致高渗性脱水。